下列属于正氮平衡的情况是
A. 创伤
B. 饥饿
C. 妊娠
D. 出血
E. 贫血

正确答案：C。妊娠

解析：氮平衡是指每日氮的输入量和排出量之间的关系，由于蛋白质中氮的成分是比较稳定的，所以可以用氮的含量来代表蛋白质的含量，也即通过氮的输入量和排出量来确定蛋白质的合成量和分解量。①创伤病人处于严重的应激状态，会消耗体内的蛋白质作为能量，并减少体内不必要的蛋白质合成，所以其氮的排出量大于氮的输入量，属于负氮平衡（A错）。②饥饿病人由于其蛋白质的摄入量不足，氮的输入量小于氮的排出量，也属于负氮平衡（B错）③妊娠妇女由于为胎儿提供营养，氮的输入量大于氮的排出量，属于正氮平衡（C对）④出血者由于血液内的大量蛋白质的丢失，造成了其蛋白质的丢失量增加，属于负氮平衡（D错）⑤贫血患者是由于各种原因导致的体内的血细胞丢失、破坏过多，最终导致体内氮排出增加，或是血细胞合成原料摄入不足，所以属于负氮平衡（E错）